不属于室内小气候构成的因素是
A. 气压
B. 气温
C. 气湿
D. 气流
E. 热辐射

正确答案：A。气压

解析：本题考查室内小气候构成的因素。室内小气候是指住宅的室内由于屋顶、地板、门窗和墙壁等围护结构以及室内的人工空气调节设备等综合作用，形成了与室外不同的室内气候。它主要由气温（B对）、气湿（C对）、气流（D对）和热辐射（E对）等四个气象因素组成。气压（A错，为本题正确答案）不属于室内小气候构成的因素。